患者，女，33岁。平素易生闷气，经行期乳房胀痛明显，此次妊娠后觉小腹胀痛不适，情志不畅，嗳气叹息，夜寐、食欲不佳，舌红，苔薄黄，脉弦滑。治宜选方
A. 调肝汤
B. 逍遥散
C. 丹栀逍遥散
D. 柴胡疏肝散
E. 小柴胡汤

正确答案：B。逍遥散

解析：该患者以妊娠后小腹胀痛不适为主要症状，故辨病为妊娠腹痛；其平素易生闷气，经行期乳房胀痛明显，伴有情志不畅，嗳气叹息，夜寐、食欲不佳，舌红，苔薄黄，脉弦滑等症状，辨证为气滞证，治宜疏肝解郁，养血安胎，方选逍遥散（B对）。调肝汤功效补益肾水，平调肝气，主治妇人肾水不足，肝气不舒，行经后少腹疼痛（A错）。丹栀逍遥散功效养血健脾，疏肝清热，主治肝郁血虚内热证（C错）。柴胡疏肝散功效疏肝解郁，行气止痛，主治肝气郁滞证（D错）。小柴胡汤功效和解少阳；主治伤寒少阳证，妇人中风，热入血室，疟疾、黄疸等病而见少阳证者（E错）。